患者女性32岁，自诉“胆小怕痛”曾有“晕针史”。检查见残根，根尖瘘管挤压无脓，治疗设计为局麻下拔除，麻醉顺利，11分钟后试麻效良好，开始操作，术中患者觉疼痛但可耐受，其后自诉头晕，胸闷，心慌，恶心，检查患者面色苍白，四肢冷而无力，脉快而弱。此时患者出现的症状是晕厥。关于造成上述症状的病因中错误的是
A. 过敏体质
B. 疼痛
C. 恐惧
D. 体位不良
E. 饥饿

正确答案：A。过敏体质

解析：本题考查局麻的并发症-晕厥。过敏体质（A错，为本题的正确答案）一般引起过敏反应，局麻药过敏反应分为分为延迟反应和即刻反应，延迟反应常是血管神经性水肿；即刻反应是用极少量药后，立即发生的类似中毒症状，表现为惊厥、昏迷、呼吸心搏骤停而死亡。恐惧（C对）、饥饿（E对）、疼痛（B对）以及体位不良（D对）可引起一时性中枢性缺血，造成晕厥发生。